功专清暑开窍的中成药是
A. 仁丹
B. 六一散
C. 清凉油
D. 清凉含片
E. 六合定中丸

正确答案：A。仁丹

解析：本题考查的是仁丹的功能。功专清暑开窍的中成药是仁丹（A对）。仁丹：【功能】清暑开窍。六一散（B错）：【功能】清暑利湿。清凉油（C错）：【功能】清凉散热，醒脑提神，止痒止痛。六合定中丸（E错）：【功能】祛暑除湿，和中消食。清凉含片（D错）的功能，2022年考试指南未明确说明。